胸导管不接受
A. 右腰干
B. 左颈干
C. 肠干
D. 左腰干
E. 右颈干

正确答案：E。右颈干

解析：胸导管由左颈干（B对)、左锁骨下干、左支气管纵隔干、左右腰干(AD对）、肠干组成（C对），右淋巴导管由右颈干（E错）、右锁骨下干和右支气管纵隔干组成。